急性盆腔炎常见的症状是
A. 高烧，白带增多，子宫及附件区压痛，WBC升高
B. 停经，下腹痛，阴道出血
C. 腹痛由脐周开始，后转移至右下腹麦氏点
D. 不孕，消瘦，输卵管碘油造影呈串珠状
E. 卵巢囊肿病史，运动后突发左侧下腹痛，B超检查囊肿消失，盆腔有少量积液

正确答案：A。高烧，白带增多，子宫及附件区压痛，WBC升高

解析：急性盆腔炎临床表现：呈急性病容，辗转不安，面部潮红，高热不退，小腹部疼痛难忍，赤白带下或恶露量多，甚至如脓血，亦可伴有腹胀、腹泻、尿频、尿急等症状。妇科检查：下腹部肌紧张、压痛、反跳痛；阴道充血，脓血性分泌物量多，宫颈充血，宫体触压痛拒按，宫体两侧压痛明显，甚至触及包块，盆腔形成脓肿，位置较低者则后穹隆饱满，有波动感。辅助检查：血常规检查见白细胞升高（A对），中性粒细胞更明显。阴道、宫腔分泌物或血培养可见致病菌，后穹隆穿刺可吸出脓液，B超探查可见盆腔内有炎性渗出液或肿块。